某项研究选择50名生育短肢畸形婴儿的母亲和90名生育正常婴儿的母亲，调查她们在怀孕初期是否服用过反应停，两组母亲分别有12人和2人回答服用过。利用上述资料回答下列问题。此项研究属于
A. 病例报告
B. 病例系列
C. 回顾性队列研究
D. 病例对照研究
E. 巢式病例对照研究

正确答案：D。病例对照研究

解析：本题考查病例对照研究的概念。病例对照研究（D对ABCE错）的基本原理是以当前已经确诊的患有某特定疾病的一组病人作为病例组，以不患有该病但具有可比性的一组个体作为对照组，通过询问、实验室检查或复查病史，搜集研究对象既往对各种可能的危险因素的暴露史，测量并采用统计学检验，比较病例组与对照组各因素暴露比例的差异是否具有统计学意义。题中对患病和不患病儿童母亲的研究属于病例对照研究。